用于治疗脚气病、多发性神经炎等的药物是
A. 维生素A醋酸酯
B. 维生素B₁
C. 维生素K₃
D. 维生素B₂
E. 维生素B₆

正确答案：B。维生素B₁

解析：本题考查各型维生素的临床作用。用于治疗脚气病、多发性神经炎等的药物是维生素B₁（B对）。维生素A醋酸酯（A错）可用于治疗维生素A缺乏症。维生素A缺乏时视网膜视紫红质和视蛋白水平降低，导致夜盲。维生素K₃（C错）属于促凝血药。维生素B₂（D错）可用于治疗维生素B₂缺乏症。维生素B₆（E错）临床上用于防治妊娠呕吐和放射病呕吐。